预防术后肺不张最主要的措施是
A. 应用大量抗生素
B. 蒸汽吸入
C. 多翻身多做深呼吸，鼓励咳嗽
D. 应用祛痰药物
E. 氧气吸入

正确答案：C。多翻身多做深呼吸，鼓励咳嗽

解析：叩击胸、背部，鼓励咳嗽和深呼吸（C对）可以有效预防术后肺不张，为预防术后肺不张的最主要措施；应用大量抗生素（A错）有助于减轻肺部感染症状，与预防术后肺不张无关；蒸汽吸入（B错）、应用祛痰药物（D错）、氧气吸入（E错）均为肺不张的缓解、治疗措施，而非预防措施。